某男，70岁，患风湿痹痛10年，去年突患中风，出现半身不遂、口眼㖞斜，请求中医诊治。医师在处方时重用蕲蛇，因此蕲蛇除祛风通络外，又能
A. 凉血消肿
B. 定惊止痉
C. 利水消肿
D. 解毒杀虫
E. 活血消肿

正确答案：B。定惊止痉

解析：本题考查的是蕲蛇的功效。蕲蛇除祛风通络外，又能定惊止痉（B对）。蕲蛇：【功效】祛风通络，定惊止痉。络石藤：【功效】祛风通络，凉血消肿（A错）。香加皮：【功效】祛风湿，强筋骨，利水消肿（C错）。雷公藤：【功效】祛风除湿，活血通络，消肿（E错）止痛，杀虫解毒（D错）。